内含雄黄的中成药是
A. 舒筋丸
B. 抱龙丸
C. 三七伤药片
D. 活血止痛散
E. 三品一条枪

正确答案：E。三品一条枪

解析：本题考查的是含有毒中药的中成药。内含雄黄的中成药是三品一条枪（E对）。三品一条枪即三品，含雄黄。含雄黄的中成药：牛黄解毒丸（片）、六神丸、喉症丸、安宫牛黄丸、牛黄清心丸、牛黄镇惊丸、牛黄抱龙丸、牛黄至宝丸、追风丸、牛黄醒消丸、紫金锭（散）、三品等。舒筋丸（A错）含马钱子。含马钱子的中成药：九分散、山药丸、舒筋丸、疏风定痛丸、伤科七味片等。抱龙丸（B错）含朱砂。含朱砂、轻粉、红粉的中成药：牛黄清心丸、牛黄抱龙丸、抱龙丸、朱砂安神丸、天王补心丸、安神补脑丸、苏合香丸、人参再造丸、安宫牛黄丸、牛黄千金散、牛黄镇惊丸、紫雪散、梅花点舌丸、紫金锭（散）、磁朱丸、更衣丸、复方芦荟胶囊。三七伤药片（C错）含乌头类药物。含乌头类药物的中成药：追风丸、追风透骨丸、三七伤药片、附子理中丸、金匮肾气丸、木瓜丸、小金丸、风湿骨痛胶囊、祛风止痛片、祛风舒筋丸、正天丸、右归丸等。活血止痛散（D错）不含有毒成分。活血止痛散：【药物组成】土鳖虫、自然铜（煅）、当归、三七、乳香（制）、冰片。